下列服用四环素后可导致乳牙变色的是
A. 胚胎29周之前
B. 胚胎29周至胎儿出生
C. 出生至8岁之间
D. 8岁之后
E. 以上均不正确

正确答案：B。胚胎29周至胎儿出生

解析：在胚胎29周至胎儿出生之间任何时候孕母摄入药物，可导致乳牙的变色，故在此期间特别要注意慎用四环素。掌握“四环素牙”知识点。